下列为含有B族维生素的辅酶，例外的是
A. 磷酸吡哆醛
B. 辅酶A
C. 细胞色素b
D. 四氢叶酸
E. 硫胺素焦磷酸

正确答案：C。细胞色素b

解析：B族维生素包括维生素B₁、维生素B₂、维生素PP、维生素B₆、维生素B₁₂、生物素、泛酸和叶酸。磷酸吡哆醛为含有维生素B₆的辅酶（A对）。辅酶A为含有泛酸的辅酶（B对）。四氢叶酸为含有叶酸的辅酶（D对）。焦磷酸硫胺素为含有维生素B₁的辅酶（E对）。细胞色素b是含有血红素样辅基的电子传递蛋白，为单电子传递体，不含有B族维生素（C错，为本题的正确答案）。